医疗机构对医师提出警告并限制其特殊使用级抗菌药物处方权的情形是
A. 开具抗菌药物处方牟取不正当利益
B. 发生抗菌药物不良事件
C. 出现开具抗菌药物超常处方3次以上且无正当理由
D. 因紧急情况越级使用抗菌药物
E. 使用的抗菌药物明显超出规定用量

正确答案：C。出现开具抗菌药物超常处方3次以上且无正当理由

解析：医疗机构对出现抗菌药物超常处方3次以上且无正当理由（C对E错）的医师提出警告，限制其特殊使用级抗菌药物处方权。开具抗菌药物处方牟取不正当利益（A错）的医师，医疗机构应当取消其处方权（P240）。按照规定开具抗菌药物处方或者使用抗菌药物而发生抗菌药物不良事件（B错）的医师，不受处罚。因紧急情况越级使用抗菌药物（D错）的医师，不受处罚（P239）。